男，65岁。5月前无明确原因咳嗽、咳痰，痰中带血，MRI示大脑半球皮质多个小类圆形低信号影，提示
A. 脑蛲虫
B. 脑脓肿
C. 脑梗塞
D. 脑转移瘤
E. 脑软化灶

正确答案：D。脑转移瘤

解析：老年男性（肺癌的好发人群）患者，无明确原因咳嗽、咳痰、痰中带血（肺癌的常见临床表现），MRI示大脑半球皮质多个小类圆形低信号影（脑转移瘤的表现），结合患者病史、临床表现和影像学表现，应考虑肺癌合并脑转移瘤（D对）。脑蛲虫（A错）多见于儿童，常有肛周瘙痒的表现，MRI多表现为较小的低密度影。脑脓肿（B错）多由化脓性细菌感染所致，病人有发热、头痛、全身乏力和肌肉酸痛等全身感染中毒症状，MRI（长T1）表现为边界不清、不规则的低密度影，周围水肿带明显。脑梗塞（C错）又称脑梗死、缺血性脑卒中，病人多有高血压、糖尿病等慢性疾病，临床上主要表现为猝然昏倒、不省人事、半身不遂、言语障碍，MRI（长T1）表现为大脑深部的低密度区，水肿和占位效应明显。脑软化灶（E错）为脑梗死的晚期表现，MRI表现为边界清楚的扇形低密度影。